药物与适当基质加热熔化后，在冷凝液中收缩冷凝而制成的小丸状制剂称为
A. 微囊
B. 滴丸
C. 栓剂
D. 微丸
E. 软胶囊

正确答案：B。滴丸